患者慢性支气管炎病史8年，近3个月咳嗽加重，持续痰中带血，伴胸闷，气急，胸痛，予抗生素治疗效果不明显。X线检查见肺门阴影增大。应首先考虑的是
A. 肺结核
B. 肺脓肿
C. 肺炎球菌肺炎
D. 原发性支气管肺癌
E. 慢性支气管炎急性发作

正确答案：D。原发性支气管肺癌

解析：患者近3个月咳嗽加重，予抗生素治疗效果不明显（刺激性咳嗽2～3周而抗感染、镇咳治疗无效），患者慢性支气管炎病史8年，近3个月咳嗽加重，持续痰中带血，伴胸闷，气急，胸痛（原有慢性呼吸道疾病，近来咳嗽性质改变者），近3个月咳嗽加重，持续痰中带血（近2～3个月持续痰中带血而无其他原因可以解释者），X线检查见肺门阴影增大（肺部孤立性圆形病灶和单侧性肺门阴影增大者），故诊断为原发性支气管肺癌（D对）。肺结核（A错）的特点为咳嗽，咳痰，痰中带血，或咯血，低热，乏力，消瘦，盗汗。肺脓肿（B错）的特点为高热，咳大量腥臭脓痰。肺炎球菌肺炎（C错）的特点为高热，咳嗽，咳铁锈色痰，胸痛。慢性支气管炎急性发作（E错）表现为咳嗽，喘息，咳白色粘液痰。